毒理学研究的最终目的是研究（）对人体的损害作用（毒作用）及其机制
A. 内源化学物
B. 外源化学物
C. 内分泌物质
D. 体内代谢物

正确答案：B。外源化学物

解析：本题考查毒理学研究的最终目的。毒理学研究的最终目的是研究外源化学物（B对ACDE错）对人体的损害作用（毒作用）及其机制。